婴幼儿唇腭裂整复术的麻醉最好选用
A. 基础麻醉加眶下神经阻滞麻醉
B. 双侧眶下神经阻滞麻醉
C. 经气管插管的全身麻醉
D. 经鼻腔气管插管的全身麻醉
E. 基础麻醉

正确答案：C。经气管插管的全身麻醉

解析：除成人可在局部麻醉（眶下孔阻滞麻醉）下进行外，唇裂整复术都应在气管内插管后施行。掌握“唇腭裂的序列治疗”知识点。